持续发热，脾大，粒细胞减少，骨髓培养伤寒杆菌阳性，应考虑的诊断是
A. 伤寒带菌者
B. 伤寒确诊病例
C. 骨髓炎
D. 伤寒临床诊断病例
E. 慢性菌痢

正确答案：B。伤寒确诊病例

解析：伤寒。以持续高热、全身中毒症状、玫瑰疹、相对缓脉、肝脾肿大和血白细胞减少等临床表现为特征，严重者可出现肠出血或肠穿孔等并发症。患者有临床症状，且结合骨髓培养可以考虑为伤寒病例（B对）。